女，18岁。月经不规律2年，阴道大量流血2周，贫血貌。B超示子宫及双侧附件未见异常。血FSH、LH、T、PRL水平正常。经过治疗止血并撤退性出血后，首选的治疗是
A. 氯米芬促排卵治疗
B. 雌孕激素序贯疗法
C. 雌激素治疗
D. 孕激素治疗
E. 雄激素治疗

正确答案：B。雌孕激素序贯疗法

解析：该患者为青春期女性（无排卵功血好发于青春期和绝境过渡期），月经不规律2年，阴道大量流血2周（经期延长、经量增多），贫血貌（长期经量过多导致贫血）。子宫及双侧附件未见异常，血FSH（卵泡刺激素）、LH（黄体生成素）、T（睾酮）、PRL（催乳素）水平正常，最可能的诊断为青春期无排卵性功血。经过治疗止血并撤退性出血后，必须调整月经周期，首选雌孕激素序贯疗法（B对），模拟自然月经周期中卵巢的内分泌变化，序贯应用雌、孕激素，使子宫内膜发生相应变化，引起周期性脱落。此法比孕激素治疗（D错）疗效好。青春期一般不提倡使用氯米芬促排卵治疗（A错）。雌激素治疗（P347）（C错）为功血的止血方法，而不是调整月经周期的方法。雄激素治疗（P348）（E错）中的丙酸睾酮具有对抗雌激素作用，减少盆腔充血和增加子宫血管张力，以减少子宫出血量，但仅仅起协助止血作用。